何者错误
A. 主要在脑干的腹侧部下行
B. 主要发自大脑皮质的运动中枢
C. 它终止于脊髓前角和脑干的脑神经运动核
D. 可分为脊髓丘脑侧束和前束
E. 属于下行(运动)传导束

正确答案：D。可分为脊髓丘脑侧束和前束

解析：锥体束主要发自大脑皮质的运动中枢，即中央前回和中央旁小叶前部（B对）。主要在脑干的腹侧部下行（A对），止于脊髓前角形成皮质脊髓束，止于脑干的脑神经运动核形成皮质核束（C对D错，为本题正确选项），属于下行(运动)传导束（E对）。